肩胛骨的特征是
A. 喙突与肩胛冈相连
B. 关节盂窝从喙突突出
C. 喙突向前及内侧突出
D. 关节盂窝从肩胛冈突出
E. 肩峰为最向外突出的部分

正确答案：E。肩峰为最向外突出的部分

解析：肩胛骨背侧面的横嵴称肩胛冈（A错），更外侧有向前的指状突起称喙突（C错）。外侧角为腋缘与上缘会合处，较肥厚，朝外侧方的梨形浅窝，称关节盂（BD错）。肩脾冈向外侧延伸的扁平突起，称肩峰, 与锁骨外侧端相接（E对）。